假设演绎法中，推出的经验证据不成立，则
A. 先行条件不成立
B. 假设不成立
C. 先行条件和假设均不成立
D. 以上均有可能
E. 假设尚待更多证据

正确答案：D。以上均有可能

解析：本题考查假设演绎法。假设演绎法中，推出的经验证据不成立，则有三种可能的结论：①假设不成立；②先行条件不成立；③假设和先行条件均不成立（D对ABCE错）。